男，63岁。晨起发现言语不清，右侧肢体活动不适，既往体健。发病后5小时体检神志清楚，血压120/80mmHg，右中枢性面瘫，舌瘫，右侧上下肢体肌力2级，右半身痛觉减退。头颅CT未见异常。病变的性质
A. 脑出血
B. 脑栓塞
C. 脑肿瘤
D. 脑血栓形成
E. 蛛网膜下腔出血

正确答案：D。脑血栓形成

解析：患者老年男性，病程短，晨起起病，有前驱症状，起病急进展快，起病5小时即发生右侧偏瘫及偏身感觉障碍，患者既往体健，考虑左侧大脑中动脉主干血栓形成（D对）可能性大（脑血栓形成多见于中老年人，多在睡眠或安静状态下起病）。脑梗死时头颅CT检查应在24-48小时才能显示出梗死灶，该患者发病5小时，故头颅CT检查正常。脑出血（A错）多在情绪激动或活动中突然发病，CT有明显的出血高密度影。脑栓塞（B错）可发生于任何年龄，以青壮年多见，多在活动中急骤发病，无前驱症状，局灶性体征在数秒至数分钟达到高峰。脑肿瘤（C错）会出现颅内压升高表现，CT表现有颅脑占位性改变。局灶蛛网膜下腔出血（E错）会有典型的头痛、脑膜刺激征和眼部症状，早期CT检查有高密度出血征。